中国营养学会提出的平衡膳食宝塔提供了
A. 食物分类的概念
B. 膳食中营养素的适宜摄入量
C. 比较理想的膳食模式
D. 理想的一日食谱
E. 每日必须摄入的食物数量

正确答案：C。比较理想的膳食模式

解析：中国营养学会提出的平衡膳食宝塔提供了一个比较理想的膳食模式（C对），同时注意了运动的重要性。膳食宝塔共五层，包括我们每天应当吃的各类主要食物，并没有给出具体的理想的一日食谱（D错），这是依据膳食中营养素的适宜摄入量（B错）来提出的。平衡膳食宝塔并没有给出食物分类的概念（A错）。膳食宝塔中给出不是每日必须摄入的食物数量（E错），而是各类食物的可食部分的生重，在实际运用中应按需转化成具体食物的重量。